判断毒物急性毒性大小最常用的指标是
A. LC₀
B. LC₅₀
C. LC₁₀₀
D. MLC
E. 以上均是

正确答案：B。LC₅₀